治疗肾盂肾炎肾阴不足，湿热留恋证，应首选
A. 丹枙逍遥散合石苇散
B. 猪苓汤
C. 知柏地黄丸
D. 八正散
E. 真武汤

正确答案：C。知柏地黄丸

解析：肾盂肾炎肾阴不足，湿热留恋证，治宜滋阴益肾，清热通淋，知柏地黄丸为首选（C对）。丹枙逍遥散合石苇散（A错），用于肝胆郁热证。猪苓汤（B错）可利水渗湿，清热养阴，治疗水热互结证。八正散（D错）可清热利湿通淋，治疗膀胱湿热证。真武汤（E错）可温阳利水，治疗脾肾阳虚，水饮内停证。